患者，女，65岁。查体：心尖搏动出现在剑突下，且深吸气时增强，肺动脉瓣第二心音增强。应首先考虑的是
A. 冠心病
B. 高血压性心脏病
C. 风心病
D. 肺心病
E. 心肌炎

正确答案：D。肺心病

解析：患者中老年女性，心尖搏动出现在剑突下，且深吸气时增强，肺动脉瓣第二心音增强，患者临床表现与慢性肺源性心脏病相符，故患者首先考虑的是肺心病（D对）。冠心病（P227）（A错）有典型的心绞痛表现，即胸骨后濒死样疼痛。高血压性心脏病（B错）发病缓慢，症状逐渐加重，早期仅有慢性高原反应及轻度肺动脉高压的表现，如头痛、疲乏无力、睡眠紊乱、食欲不振等，随着病情的进一步发展，出现心悸、胸闷、呼吸困难、颈静脉怒张、肝脏肿大、下肢水肿等右心功能不全的表现。风心病（P298）（C错）表现二尖瓣狭窄、二尖瓣关闭不全、主动脉瓣狭窄或主动脉瓣关闭不全的体征。心肌炎（P282）（E错）患者常有各种心律失常，以房性与室性期前收缩及房室传导阻滞最为多见，听诊可闻及第三、第四心音或奔马律，部分患者可闻及心尖区收缩期吹风样杂音。